患者无心力衰竭的症状和（或）体征，但已出现心脏结构的改变，其心功能分期是
A. C期
B. 不能分期
C. A期
D. B期
E. D期

正确答案：D。B期

解析：心力衰竭时心功能分期可分为四个阶段：心功能A期（前心衰阶段）（C错）指患者存在高危因素，但尚无心脏心脏结构或功能异常，也无心力衰竭的症状和（或）体征；心功能B期（前临床心衰阶段）（D对B错）指患者患者无心衰的症状和（或）体征，已出现心脏结构的改变；心功能C期（临床心衰阶段）（A错）指患者已有基础结构性心脏病，既往或目前有心衰的症状和（或）体征；心功能D期（难治性终末期心衰阶段）（E错）指患者虽经严格优化内科治疗，但休息时仍有症状，需反复长期住院。